下列食物成分进入十二指肠后，刺激促胆囊收缩素分泌作用最强的是
A. 电解质
B. 碳水化合物
C. 脂肪
D. 蛋白质
E. 纤维素

正确答案：D。蛋白质

解析：引起缩胆囊素释放的因素按由强至弱的顺序为蛋白质分解产物、脂酸钠、盐酸、脂肪；碳水化合物没有刺激作用（D对）。